治疗外伤引起的水疝，应首选
A. 济生肾气丸
B. 大分清饮
C. 加味五苓散
D. 宝鉴当归四逆汤
E. 活血散瘀汤加味

正确答案：E。活血散瘀汤加味

解析：水疝是指阴囊内有水湿停滞，不红不热，状如水晶为特征的病症，肝寒不疏，脾虚不运，肾虚失约，或先天禀赋不足，外伤络阻，水液不行都可引起。活血散瘀汤活血散瘀，行气利水，擅长治疗由于由外伤导致瘀血阻络的水疝，瘀血去，则水液输布正常（E对）。济生肾气丸具有温肾通阳，化气行水之功，适于先天禀赋不足的水疝、肾气不足的尿石症、肾阳虚损的慢性前列腺炎、肾阳不足的精癃（A错）。大分清饮功能清热利湿通淋，适于湿热下注的水疝（B错）。加味五苓散具有利湿行水之功效，适于寒凉伤脏，而为呕吐、泻利、腹痛等病症（C错）。宝鉴当归四逆汤具有温经散寒，养血通脉之功效，适于疝气，症见脐腹冷痛相引腰胯而痛（D错）。